甲药品研究所研制了一种化学创新药，已成功获得药品注册证书，成为药品上市许可持有人。为使该新药尽快上市，甲委托乙化学药品生产企业生产该药品，同时委托具备相应经营范围的丙药品经营企业销售该药品。两年后，甲决定自行生产该药品。关于甲、乙、丙的说法，错误的是
A. 甲、乙承担药品生产环节的质量责任
B. 甲是药品安全的第一责任人
C. 甲、乙、丙均应当建立药品质量保证体系
D. 甲、乙、丙承担药品经营环节的质量责任

正确答案：D。甲、乙、丙承担药品经营环节的质量责任

解析：本题考查药品上市许可持有人的权力和义务。甲药品研究所研制了一种化学创新药，已成功获得药品注册证书，成为药品上市许可持有人。为使该新药尽快上市，甲委托乙化学药品生产企业生产该药品，同时委托具备相应经营范围的丙药品经营企业销售该药品。两年后，甲决定自行生产该药品。关于甲、乙、丙的说法，错误的是甲、乙、丙承担药品经营环节的质量责任（D错，为本题正确答案）。药品上市许可持有人和受托生产企业（乙）应当签订委托协议和质量协议，并严格履行协议约定的义务（A对）。药品上市许可持有人和受托经营企业（丙）应当签订委托协议，并严格履行协议约定的义务。药品上市许可持有人的法定代表人、主要负责人（甲）对药品质量全面负责（B对）。药品上市许可持有人（甲）应当建立药品质量保证体系，配备专门人员独立负责药品质量管理。从事药品生产活动（乙），应当遵守药品生产质量管理规范，建立健全药品生产质量管理体系，保证药品生产全过程持续符合法定要求。从事药品经营活动（丙），应当遵守药品生产质量管理规范，建立健全药品生产质量管理体系，保证药品生产全过程持续符合法定要求（C对）。